盐酸溴己新为
A. 解热镇痛药
B. 催眠镇静药
C. 抗精神病药
D. 镇咳祛痰药
E. 降血压药

正确答案：D。镇咳祛痰药

解析：本题考查祛痰药溴己新。祛痰药（D对）主要有溴己新、氨溴索、乙酰半胱氨酸和羧甲司坦。解热镇痛药（A错）主要有水杨酸类（阿司匹林）和乙酰苯胺类（对乙酰氨基酚）。镇静催眠药物（B错）分为苯二氮䓬类（地西泮）和非苯二氮䓬类（佐匹克隆）。抗精神病药物（C错）主要有吩噻嗪类氯丙嗪等。抗高血压药（E错）主要有卡托普利、依那普利、福辛普利等。